治疗哮病风痰哮证，应首选
A. 射干麻黄汤
B. 三子养亲汤
C. 定喘汤
D. 厚朴麻黄汤
E. 麻杏石甘汤

正确答案：B。三子养亲汤

解析：哮病风痰哮为痰浊伏肺，风邪引触，肺气郁闭，升降失司，治宜祛风涤痰，降气平喘，首选温肺化痰，降气消食之三子养亲汤（B对）。射干麻黄汤功能温肺化饮，止哮平喘，为哮病冷哮证的选方（A错）。定喘汤功能清热宣肺，化痰平喘，为哮病热哮证的选方（C错）。厚朴麻黄汤功能解表散寒，清热化痰，为哮病寒包热哮证的选方（D错）。麻杏石甘汤功能宣肺泄热，降气平喘，为喘证表寒肺热证的选方（E错）。